对肾被膜不正确的叙述是
A. 由内向外依次为纤维囊、脂肪囊和肾筋膜
B. 在正常情况下，纤维囊与肾实质易剥离，若剥离困难,即属病理情况
C. 肾筋膜向下，前、后两层分离，其间有输尿管通过
D. 脂肪囊也称肾床，对肾具有缓冲振荡的作用，临床上作肾囊封闭，即是将药物注入此囊
E. 肾筋膜对肾无任何固定作用

正确答案：E。肾筋膜对肾无任何固定作用

解析：肾的被膜由内向外依次为纤维囊、脂肪囊与肾筋膜（A对）。纤维囊与肾实质易剥离，若剥离困难, 即属病理情况（B对）；脂肪囊又称肾床，为肾囊封闭的位点（D对）。肾筋膜具有固定肾脏的功能（E错，为本题正确答案），肾前筋膜和肾后筋膜在肾的下方则互相分离，其间有输尿管通过（C对）。